化学消毒剂是指用于杀灭下列哪项的化学药物
A. 微生物
B. 寄生虫
C. 真菌
D. 病原微生物
E. 细菌

正确答案：D。病原微生物

解析：本题考查化学消毒剂。化学消毒剂是指用于杀灭病原微生物（D对ABCE错）的化学药物。